男，过敏性休克，使用肾上腺素，心血管系统可出现的反应是
A. 减慢心率
B. 降低机体代谢
C. 心率加快
D. 降低心肌收缩性
E. 禁止用于支气管哮喘

正确答案：C。心率加快

解析：肾上腺素主要激动α和β受体，作用与机体的生理病理状态、靶器官中肾上腺素受体亚型的分布、整体的反射作用和神经末梢突出间隙的反馈调节等因素有关。过敏性休克表现为小血管扩张和毛细血管通透性增加，出现循环血量降低，血压下降，同时支气管平滑肌痉挛，出现呼吸困难，使用肾上腺素治疗过敏性休克，其激动α₁受体，收缩小动脉和毛细血管前括约肌，而降低后者的通透性，激动β₁受体改善心功能出现心肌收缩力增强（D错）、心率增快（A错C对），减少过敏介质释放，扩张冠状动脉，因此可迅速缓解过敏性休克的临床症状，是治疗过敏性休克的首选药物。作用于支气管平滑肌的β₂受体，发挥强大的舒张支气管作用，缓解支气管痉挛（E错）。另外，肾上腺素能提高机体代谢率（B错），治疗剂量使耗氧量增加20%～30%，具有明显升血糖作用，增强脂肪分解。